HBV处于复制状态，有传染性的标志是
A. 抗-HBe
B. HBeAg
C. 抗-HBs
D. HBsAg
E. 抗-HBc

正确答案：B。HBeAg

解析：HBV指乙型肝炎，乙型肝炎病毒处于复制状态，说明乙型肝炎处于活动期，具有强烈的传染性，此时HBeAg的检出率升高，所以HBeAg阳性为HBV处于复制状态，具有传染性的标志（B对）。抗HBe（A错）在HBeAg消失后产生，提示HBV复制减弱或趋于停止。抗HBs阳性（C错）见于HBV感染恢复和乙肝疫苗免疫接种成功，对HBV再感染具有保护作用。HBsAg（D错）是HBV感染的血清学标志，HBV感染后早至1～2周，迟则11～12周可检出5急性自限性肝炎于6个月内消失，在无症状携带者或慢性乙型肝炎患者中HBsAg可持续存在多年，甚至终生。HBcAg存在于HBV颗粒的核心及感染的肝细胞核内，血液中不易检出，但其抗原性强，于感染后早期即可刺激机体产生抗HBc（E错），抗HBcIgM为急性感染及慢性感染病情活动的标志，抗HBcIgG出现较迟，见于急性感染恢复期和慢性感染期。